在一定范围内，其水平与动脉粥样硬化和冠心病的发生、发展呈负相关的指标是
A. HDL-C
B. HbA₁c
C. TG
D. LDL-C
E. TC

正确答案：A。HDL-C

解析：本题考查HDL-C。在一定范围内，其水平与动脉粥样硬化和冠心病的发生、发展呈负相关的指标是HDL-C（A对）。HDL-C（高密度脂蛋白胆固醇）、TG（C错）（三酰甘油）、LDL-C（D错）（低密度脂蛋白胆固醇）、TC（E错）（总胆固醇）均为血脂水平的指标，其中HDL-C（高密度脂蛋白胆固醇）水平与动脉粥样硬化和冠心病的发生和发展呈负相关。HbA₁c（B错）（糖化血红蛋白）能客观反映测定前3个月内的平均血糖水平。